女性，35岁。近2个月来发热，乏力伴消瘦。体检：左颈、二侧腋窝和腹股沟部位可触及数个黄豆和蚕豆大小淋巴结，肝未及，脾肋下3cm，红细胞4.0✕10¹²/L，血红蛋白12g/L，白细胞5.6✕10⁹/L，血小板150✕10⁹/L，血沉80mm/h。如需明确诊断，首先应做的检查是
A. 肝功能
B. CT检查
C. 磁共振
D. 淋巴结活检
E. B超

正确答案：D。淋巴结活检